代谢性酸中毒时机体发生的变化中哪一项例外
A. 心肌收缩力减弱
B. 血管对儿茶酚胺反应性显著升高
C. 呼吸运动增强
D. 中枢神经系统抑制
E. 心律失常

正确答案：B。血管对儿茶酚胺反应性显著升高

解析：代谢性酸中毒时机体表现心肌收缩力减弱（A对），血管系统对儿茶酚胺的反应性降低（B错，为本题正确答案）、中枢神经系统抑制（D对），高血钾可导致室性心律失常（E对）。血液H+浓度增加可通过刺激颈动脉体和主动脉体化学感受器，反射性引起呼吸中枢兴奋，呼吸运动增强（C对）。